胫骨
A. 小腿的承重骨
B. 与腓骨长度相等
C. 下端膨大为外踝
D. 内侧缘锐利
E. 滋养孔开口向下

正确答案：A。小腿的承重骨

解析：胫骨为小腿主要承重骨（A对）。胫腓骨长度不等（B错），腓骨下端膨大为外踝（C错）。腓骨体内侧缘锐利，称骨间缘（D错）。胫骨体上、中 1/3 交界处附近，有向上开口的滋养孔（E错）。